男，35岁。转移性右下腹痛2天。右下腹部压痛，肌紧张，反跳痛，肠鸣音减弱。白细胞计数及中性分类明显增高。其诊断首先考虑
A. 胃十二指肠溃疡穿孔
B. 急性胆囊炎并穿孔
C. 绞窄性肠梗阻
D. 急性肠系膜淋巴结炎
E. 急性阑尾炎穿孔

正确答案：E。急性阑尾炎穿孔

解析：青年男性患者，转移性右下腹痛2天（急性阑尾炎最常见最重要的体征就是转移性右下腹痛），右下腹部压痛，肌紧张，反跳痛，提示急性阑尾炎，且肠鸣音减弱（这是壁腹膜受炎症刺激出现的防卫性反应，提示阑尾炎症加重，出现化脓、坏疽或穿孔等病理改变），白细胞计数及中性分类明显增高（成人WBC正常值4.0～10.0×10⁹／L，中性分类正常约为50～70%，大多数急性阑尾炎病人的白细胞计数和中性粒细胞比例增高），综合病人症状、体征、实验室检查可诊断为急性阑尾炎穿孔（E对）。胃十二指肠溃疡穿孔（A错）（P340）主要表现为突发上腹部剧痛，呈“刀割样”，腹痛迅速波及全腹，腹式呼吸减弱或消失，腹肌紧张呈“板状腹”，立位X线可见膈下新月状游离气体影。急性胆囊炎并穿孔（B错），因胆囊是个盲袋，当胆囊管梗阻又因急性炎症使胆囊内压力升高时，可引起胆囊壁的血液循环障碍、胆囊坏疽，并可发生穿孔，常表现为右上腹持续性疼痛，无转移性右下腹痛。绞窄性肠梗阻（C错）（P358）主要表现为腹痛发作急骤，间歇期缩短，成为剧烈的持续性腹痛，腹胀不对称等。急性肠系膜淋巴结炎（D错）主要表现为多见于小儿，可有发热、阵发性疼痛、腹膜刺激症轻微。